某男，60岁。气虚乏力，阴虚口干，时而遗精。证属气阴两虚、肾虚不固，治当益气养阴、固精，宜选用的药是
A. 山药
B. 黄芪
C. 大枣
D. 红景天
E. 西洋参

正确答案：A。山药

解析：本题考查的是山药的功效。气虚乏力，阴虚口干，时而遗精。证属气阴两虚、肾虚不固，治当益气养阴、固精，宜选用的药是山药（A对）。山药：【功效】益气养阴，补脾肺肾，固精止带。黄芪（B错）：【功效】补气升阳，益卫固表，托毒生肌，利水消肿。大枣（C错）：【功效】补中益气，养血安神，缓和药性。红景天（D错）：【功效】益气，平喘，活血通脉。西洋参（E错）：【功效】补气养阴，清热生津。